氟哌酸是诺氟沙星的
A. 通用名
B. 化学名
C. 商品名
D. 注册名
E. 习用名

正确答案：E。习用名

解析：本题考查药物的名称。氟哌酸是诺氟沙星的习用名（E对）。有些药物的名称因常被应用，可称之为该药的别名或习用名，如先锋4号是头孢氨苄的习用名等。药品通用名（A错）也称为国际非专利药品名称（INN），通常是指有活性的药物物质，而不是最终的药品，因此是药学研究人员和医务人员使用的共同名称，如西咪替丁是甲氰咪胍的通用名。药物的化学名（B错）是根据药品的化学成分确定的化学学术名称。药品的商品名（C错）通常是针对药物的最终产品，即剂量和剂型已确定的含有一种或多种药物活性成分的药物。药品的注册名（D错）新版大纲未明确要求。